生物碱分子中氮原子杂化方式与其碱性强弱的关系是
A. sp＞sp²＞sp³
B. sp＞sp³＞sp²
C. sp³＞sp²＞sp
D. sp³＞sp＞sp²
E. sp²＞sp³＞sp

正确答案：C。sp³＞sp²＞sp

解析：本题考查的是生物碱碱性强弱与分子中氮原子的杂化方式的关系。生物碱分子中氮原子杂化方式与其碱性强弱的关系是sp³＞sp²＞sp（C对）。生物碱碱性强弱与分子中氮原子的杂化方式的关系：含氮化合物氮原子的孤对电子都处于杂化轨道上，其碱性随轨道中s成分比例的增加而减弱，即sp³＞sp²＞sp。由于p电子距核远，其未共用电子对的活动性大，易给出电子，碱性强。反之，s电子比例越大，碱性越弱。一般脂胺类、脂氮杂环类生物碱的氮原子为sp³杂化，为中强碱；芳香胺类、六元芳杂环类生物碱的氮原子为sp²，为弱碱；而带氰基的氮原子为sp杂化，呈中性。例如，四氢异喹啉的碱性（氮sp³杂化）比异喹啉（氮sp²杂化）强；由它们衍生的生物碱，可待因的碱性（氮sp³杂化）大于罂粟碱（氮sp²杂化）；烟碱分子中的两个氮原子，四氢吡咯环上的氮属仲胺类（sp³杂化），吡啶环上的氮属芳杂环类（sp²杂化），其碱性前者明显强于后者。